口腔颌面部恶性肿瘤的组织来源最多的是
A. 上皮组织
B. 腺源性
C. 间叶组织
D. 牙源性
E. 以上都不对

正确答案：A。上皮组织

解析：口腔颌面部恶性肿瘤以上皮组织来源最多，尤其是鳞状上皮细胞癌最为常见，约占口腔颌面部恶性肿瘤80%（口腔恶性肿瘤约90%）以上；其次为腺源性上皮癌及未分化癌；肉瘤发生于口腔颌面部者较少，主要为纤维肉瘤、骨肉瘤等。掌握“口腔颌面部肿瘤的概念、临床表现、诊断”知识点。